可用作混悬剂中稳定剂的有
A. 增溶剂
B. 助悬剂
C. 乳化剂
D. 润湿剂
E. 絮凝剂

正确答案：B、D、E。助悬剂；润湿剂；絮凝剂

解析：本题考查混悬剂。混悬剂中稳定剂包括助悬剂（B对）、润湿剂（D对）、絮凝剂（E对）或反絮凝剂等。增溶剂（A错）、乳化剂（C错）均不属于混悬剂的稳定剂。